患者，男，42岁。呼吸气促，喉中哮鸣有声，胸闷如窒，口不渴，形寒肢冷，面色晦暗，舌苔白滑，脉弦紧。治疗应首选
A. 二陈汤
B. 麻黄汤
C. 定喘汤
D. 射干麻黄汤
E. 平喘固本汤

正确答案：D。射干麻黄汤

解析：患者呼吸气促，喉中哮鸣有声，可诊断为哮病。患者口不渴，形寒肢冷，面色晦暗，可辨证为寒哮；舌苔白滑，脉弦紧为寒证的表现。寒痰伏肺，遇感触发，痰升气阻，痰气相搏，以致呼吸急促而哮鸣有声；痰不能从咳而出，肺气郁闭，不得宣畅，故胸闷如窒；阴盛于内，阳气不能宣达，故面色晦暗，形寒肢冷；舌苔白滑，脉弦紧，皆为寒痰之象；治宜宣肺散寒，化痰平喘；代表方为射干麻黄汤（D对）。二陈汤功效燥湿化痰，理气和中，主治湿痰证（A错）。麻黄汤功效发汗解表，宣肺平喘，主治外感风寒表实证（B错）。定喘汤功效宣肺降气，清热化痰，主治痰热内蕴，风寒外束之哮喘（C错）。平喘固本汤功效补肺纳肾，降气化痰，主治肺胀，肺肾气虚，喘咳有痰者（E错）。